白血病患者口腔表现不包括
A. 牙龈苍白或暗红、无弹性
B. 牙龈有出血倾向，不易止血
C. 牙龈缘常有坏死
D. 常见牙齿松动移位
E. 牙龈肿大波及全口牙

正确答案：D。常见牙齿松动移位

解析：本题考查白血病的牙龈病损的临床表现。白血病的牙龈病损局限于牙龈未损害牙槽骨，牙齿松动移位不常见（D错，为本题的正确答案）。白血病的牙龈病损的临床表现有：牙龈肿大，颜色苍白或暗红、无弹性（A对），表面光亮、波及全口牙（E对）。由于牙龈中大量幼稚血细胞浸润积聚，可造成末梢血管栓塞，局部组织对感染的抵抗力降低，龈缘常有坏死（C对）、溃疡和假膜形成。牙龈有明显的出血倾向，不易止血（B对）。